既能清热息风，又能平喘利尿的药物是
A. 地龙
B. 僵蚕
C. 蜈蚣
D. 全蝎
E. 天麻

正确答案：A。地龙

解析：地龙的功效是清热定惊，通络，平喘，利尿（A对）。僵蚕（B错）的功效是息风止痉，祛风止痛，化痰散结。蜈蚣（C错）的功效是息风镇痉，通络止痛，攻毒散结。全蝎（D错）的功效是息风镇痉，通络止痛，攻毒散结。天麻（E错）的功效是息风止痉，平抑肝阳，祛风通络。